损伤后不能做推车动作并出现“翼状肩”征
A. 肩胛提肌
B. 胸小肌
C. 前锯肌
D. 菱形肌
E. 斜方肌

正确答案：C。前锯肌

解析：损伤后不能做推车动作并出现“翼状肩”征是前锯肌（C对）。